高血钾症有效治疗
A. 氯化钾
B. 碳酸氢钠溶液
C. 螺内酯
D. 新斯的明
E. 肾上腺皮质激素

正确答案：B。碳酸氢钠溶液

解析：碳酸氢钠溶液（B对）对治疗高血钾症有效。静脉输注5%碳酸氢钠溶液后，既可使血清K⁺得到稀释，又能使K⁺移入细胞内或由尿排出，故可降低血钾浓度。氯化钾（A错）主要用于治疗低钾血症。螺内酯（C错）为醛固酮的竞争性抑制剂，是一种保钾利尿剂，常与排钾性利尿药合用，可以在利尿的同时预防低钾血症。新斯的明（D错）为胆碱酯酶抑制药，主要用于治疗重症肌无力及腹部手术后的肠麻痹。肾上腺皮质激素（E错）主要用于危重病人的抢救及其他药物治疗无效的某些慢性病。